影响牙石形成的因素
A. 唾液
B. 菌斑
C. 口腔卫生习惯
D. 修复体的光洁度
E. 以上均是

正确答案：E。以上均是

解析：唾液、菌斑、口腔卫生习惯、修复体的光洁度、口腔环境等都会影响牙石形成。掌握“牙周疾病促进因素”知识点。